休克经处理后，下列哪项是临床上微循环改善的最重要指标
A. 血压回升
B. 尿量增多
C. 肢端温度上升
D. 皮肤颜色转红
E. 神志恢复清楚

正确答案：B。尿量增多

解析：尿量是反映肾血液灌注情况的有效指标，也是反映微循环的改善的最重要指标。掌握“休克”知识点。